关于面神经的描述，正确的是
A. 内脏运动纤维支配腮腺、舌下腺、下颌下腺的分泌
B. 内脏感觉纤维接受舌后1／3的味觉和一般感觉
C. 面神经管内一般无分支发出
D. 面神经损伤口角歪向健侧，伤侧额纹消失
E. 面神经损伤不可能出现泪腺分泌障碍

正确答案：D。面神经损伤口角歪向健侧，伤侧额纹消失

解析：面神经含有特殊内脏运动、一般内脏运动、特殊内脏感觉和一般躯体感觉四种纤维成分，其中特殊内脏运动纤维支配面部表情肌；一般内脏运动纤维支配泪腺、舌下腺、下颌下腺以及鼻腔、口腔黏膜腺体的分泌（A错）；特殊内脏感觉纤维接受舌前2／3的味觉（B错）。面神经在经过面神经管时会发出分支鼓索、岩大神经、镫骨肌神经（C错）。根据面神经行程及各种纤维支配的部位，得知面神经管外损伤时可出现同侧表情肌瘫痪，表现为口角歪向健侧，伤侧额纹消失（D对）等表现；面神经管内损伤时可出现泪腺分泌障碍（E错）等表现。